太阳病，关节疼痛而烦，脉沉而细者，此名
A. 血痹
B. 历节
C. 痛痹
D. 湿痹
E. 风痹

正确答案：D。湿痹

解析：湿痹本是湿邪侵犯太阳之表，并流注关节筋脉为主的一种病证，故以关节烦疼为特征（D对）。倘患者脾胃功能虚弱，或外湿内趋。则会形成内外混相合的证候。湿邪内阻，影响膀胱气化则小便不利。湿趋大肠则大便反快。若内湿不去，则阳气被遏，难以祛除外湿，故但当利其小便。小便得利则内湿去，阳气通，有助于祛除外湿。